27岁，男性，病程5年，性格孤僻，不上班，将自己的东西都卖掉，流浪街头，睡门洞，在饭店讨饭吃，时有自言自语，经常呼唤着因病过世的母亲的名字。精神检查：意识清晰，衣着不整，表情淡漠，对人冷淡，常对人冷笑，孤僻离群，时有奇怪想法，如“不能利用出现的一种倾向掩盖另一种倾向”。躯体及神经系统检查无异常，该患者诊断是
A. 分裂性人格
B. 精神分裂症
C. 抑郁症
D. 精神发育迟滞
E. 脑器质性精神障碍

正确答案：B。精神分裂症

解析：青年患者，病程5年，性格孤僻（前驱期的典型症状），不上班，将自己的东西都卖掉，流浪街头，睡门洞，在饭店讨饭吃，时有自言自语，经常呼唤着因病过世的母亲的名字（典型的怪异行为），精神检查：意识清晰，衣着不整，表情淡漠，对人冷淡，常对人冷笑，孤僻离群，时有奇怪想法，根据该患者的症状及精神检查，考虑该患者最可能的诊断是精神分裂症（B对），本病是指以明显的阳性症状、阴性症状、精神运动性障碍及现实检验能力严重受损为特征的一组精神障碍。分裂性人格（A错）敏感多疑，他们总是妄自尊大，而又极易产生羞愧感和耻辱感。抑郁症（C错）主要表现为无望、无助、无价值；自责、自罪、自杀。精神发育迟滞（D错）是一组以智能低下和社会适应困难为显著临床特征的精神障碍。多在中枢神经系统发育成熟（18岁）以前起病。脑器质性精神障碍（E错）中枢神经系统的器质性病变，神经系统病史和体征及相关辅助检查有助于鉴别。